关于腹膜解剖生理的叙述，正确的是
A. 腹膜分为壁腹膜、脏腹膜、肠系膜、网膜四个部分
B. 腹膜有很多皱襞，因此具有较大的表面积，相当于人体皮肤表面积的1.7～2倍
C. 腹膜上具有丰富的腺体，在急性炎症时能够分泌大量的液体以稀释有害物质
D. 正常情况下，腹腔内有75～100ml澄清液体和少量气体以润滑、间隔腹腔内脏器
E. 腹膜具有很强的吸收能力，能够吸收腹腔内的积液、血液和细菌毒素

正确答案：E。腹膜具有很强的吸收能力，能够吸收腹腔内的积液、血液和细菌毒素

解析：腹膜分为壁腹膜和脏腹膜两部分。壁腹膜贴附于腹壁、横膈脏面和盆壁的内面；脏腹膜覆盖于内脏表面。肠系膜和网膜是脏腹膜在腹腔内形成的结构（A错）。腹膜有很强的吸收能力，可吸收腹腔内的积液、血液和细菌毒素等（E对）。腹膜有很多皱襞，其面积几乎与全身的皮肤面积相等，约为1.7～2.0m²（B错）。腺体是指能够产生特殊物质（如激素、消化液）的组织，急性炎症时，腹膜内的毛细血管通透性增加，可产生大量渗出液，而非腹膜自身分泌（C错）；在急性炎症时，腹膜可分泌大量渗出液，以稀释毒素和减少刺激。脏、壁层腹膜之间潜在的腔隙称为腹膜腔，腹膜腔是人体最大的体腔，可分为大、小腹腔两部分，即腹腔和网膜囊。正常情况下，腹腔内有75～100ml液体，起润滑、间隔腹腔内脏器的作用；病变时腹膜腔内可出现气体（D错）。